关于唇癌的叙述，哪项是错误的
A. 主要为鳞癌，腺癌很少见
B. 多发生于下唇
C. 下唇癌的转移较上唇早
D. 唇癌的转移一般较其他口腔癌为少见
E. 下唇癌常向颏下及颌下淋巴结转移

正确答案：C。下唇癌的转移较上唇早

解析：唇癌为发生于唇红缘黏膜的鳞状细胞癌，腺癌少见。多发生于下唇，下唇癌常向颏下及下颌下淋巴结转移，而上唇癌常向耳前、下颌下及颈淋巴结转移，且上唇癌的转移较下唇早并多见。一般唇癌的转移较其他口腔癌少见，其转移时间较迟。掌握“颊癌、口底癌及唇癌”知识点。